关于人类胚胎干细胞研究和应用的伦理原则，错误的是
A. 无论胚胎是不是人，都应该得到尊重
B. 需先经动物实验等措施.以符合安全和有效的原则
C. 禁止故意生产销售买卖配子和胚胎等，以防止商品化
D. 配子和胚胎等属于个人财产，允许买卖，符合公平的原则
E. 与病人或受试者有关的信息应充分告知

正确答案：D。配子和胚胎等属于个人财产，允许买卖，符合公平的原则

解析：进行人胚胎干细胞研究，必须遵守以下行为规范：禁止买卖人类配子、受精卵、胚胎和胎儿组织（D错，为本题正确答案）（A对C对）。许多疾病的动物模型不能准确地反映人类疾病，且动物毒理学实验难以预测对人类的毒性；人类细胞移植到动物机体的实验不能有效预测人体对移植细胞的免疫和其他生物学反应（B错）。剩余胚胎和胎儿组织的获得，必须经捐赠者的知情同意，而有些知情同意需要详细说明，包括捐献者不会得到捐赠之后任何有关胎儿组织或细胞试验的信息、一切有关该细胞的标识将被去除、捐赠者不会从该细胞研究中获得任何经济上的回报（E错）。